子宫颈原位癌累及腺体是指
A. 子宫颈腺体充满癌细胞
B. 子宫颈表面发生的原位癌影响腺体分泌排出
C. 子宫颈表面和腺体先后发生了原位癌，并侵及腺体周围间质
D. 子宫颈原位癌突破基底膜侵及腺体
E. 子宫颈原位癌沿基底膜伸入腺体内致腺管上皮为癌细胞所取代，腺体基底膜完整

正确答案：E。子宫颈原位癌沿基底膜伸入腺体内致腺管上皮为癌细胞所取代，腺体基底膜完整

解析：此为定义题。子宫颈原位癌是指病变细胞累及全部上皮层，但是未突破基底膜（P302）；子宫颈原位癌累及腺体是指子宫颈原位癌沿基底膜伸入腺体内致腺管上皮为癌细胞所取代，腺体基底膜完整（E对）。